调查麻疹、痢疾等家庭续发率所选的对象为
A. 自然人群（包括以往有过该传染病史或有过预防接种史者）
B. 健康人群（除去有预防接种史与传染病史者）
C. 易感人群
D. 传染病的接触人群
E. 特殊人群

正确答案：D。传染病的接触人群